疾病监测的目的不包括
A. 验证病因假设
B. 预测疾病流行
C. 评级预防
D. 描述疾病分布
E. 监测疾病爆发

正确答案：A。验证病因假设

解析：疾病监测的目的包括预测疾病流行（B对）、评级预防（C对）、描述疾病分布（D对）、监测疾病爆发（E对）。不包括验证病因假设（A错）。验证病因假设多采用分析性研究方法或用实验性研究方法（P96）。